鼻泪管末端开口于
A. 泪点
B. 上鼻道
C. 下鼻道
D. 中鼻道
E. 咽隐窝

正确答案：C。下鼻道

解析：鼻泪管开口于下鼻道（C对）。